关于腹腔神经节的描述，何者是正确的
A. 为交感神经节，节后纤维支配结肠左曲以上的腹腔内消化管和腹腔脏器
B. 为副交感神经节，节前纤维来自迷走神经
C. 为椎旁神经节
D. 为器官旁神经节
E. 为内脏感觉神经节

正确答案：A。为交感神经节，节后纤维支配结肠左曲以上的腹腔内消化管和腹腔脏器

解析：腹腔神经节为交感神经节，节后纤维支配结肠左曲以上的腹腔内消化管和腹腔脏器（A对）。